慢性胃炎最主要的病因是
A. 刺激性食物
B. 化学损伤
C. 幽门螺杆菌感染
D. 药物损伤
E. 物理损伤

正确答案：C。幽门螺杆菌感染

解析：慢性胃炎的病因有幽门螺杆菌感染、十二指肠-胃反流、自身免疫、年龄因素和胃黏膜营养因子缺乏，其中幽门螺杆菌感染是最主要的病因（C对）。刺激性食物（A错）、化学损伤（B错）、药物损伤（D错）、物理损伤（E错）均为急性胃炎的病因。